含有2个胚层以上成分的肿瘤是
A. 神经纤维瘤
B. 软骨母细胞瘤
C. 骨母细胞瘤
D. 成熟性畸胎瘤
E. 髓母细胞瘤

正确答案：D。成熟性畸胎瘤

解析：成熟性畸胎瘤（D对）来源于生殖细胞，大多数肿瘤含有2个以上胚层组织成分。骨母细胞瘤（C错）、软骨母细胞瘤（B错）和神经纤维瘤（P348）（A错）为良性肿瘤，髓母细胞瘤（E错）为恶性肿瘤，三者均无2个以上胚层成分（P84）。